关于药物理化性质的说法，错误的是
A. 弱酸性药物在酸性胃液中解离度低，易在胃中吸收
B. 药物的脂溶性高，则药物在体内的吸收越好
C. 药物的脂水分配值（lgP）用于衡量药物的脂溶性
D. 由于肠道比胃的pH高，所以弱碱性药物在肠道中比在胃中容易吸收
E. 由于体内不同部位的pH值不同，所以同一药物在体内不同部位的解离不同程度

正确答案：B。药物的脂溶性高，则药物在体内的吸收越好

解析：本题考查药物的理化性质与药物活性。人体内大部分环境为水相环境，因此药物需要有亲水性；而生物膜是由磷脂双分子层组成，药物通过生物膜也需要有亲脂性，因此药物需要同时具有亲水性和亲脂性。药物亲水性或亲脂性的过高或过低都会对药效产生不利影响（B错，为本题正确答案）。弱酸性药物在酸性胃液中多数以分子形式存在，在胃中易于吸收（A对）。脂水分配系数P为化合物在脂相和水相间达到平衡时的浓度比值，通常是以化合物在有机相中的浓度为分子，在水相中的浓度为分母，可以用来衡量药物的脂溶性，常用其对数lgP来表示（C对）。胃液较肠道消化液更酸，故肠道比胃的pH高，所以弱碱性药物在肠道中比在胃中容易吸收（D对）。由于体内不同部位的pH值不同，影响药物的解离程度，所以同一药物在体内不同部位的解离不同程度（E对）。